引起发芽马铃薯食物中毒的毒性物质是
A. 龙葵素
B. 皂素
C. 类秋水仙碱
D. 氰苷
E. 亚硝酸盐

正确答案：A。龙葵素